下列哪项不是蛤蚧的性状特征
A. 头略呈三角形
B. 吻鳞切鼻孔
C. 背部有黄白色、灰绿色或砖红色斑点
D. 尾长与体长近相等
E. 四足均有5趾，趾底面有吸盘

正确答案：B。吻鳞切鼻孔

解析：本题考查的是蛤蚧药材的性状鉴别。蛤蚧吻鳞不切鼻孔（B错，为本题正确答案）。蛤蚧：【性状鉴别】药材呈扁片状，头颈部及躯干部长9～18cm，头颈部约占三分之一，腹背部宽6～11cm，尾长6～12cm。头略呈扁三角形（A对），两眼多凹陷成窟窿，口内角质细齿，生于颚的边缘，无异型大齿。吻部半圆形，吻鳞不切鼻孔，与鼻鳞相连。腹背部呈椭圆形，腹薄。背部灰黑色或银灰色，有黄白色或灰绿色斑点或橙红色斑点散在（C对）或密集成不显著的斑纹，脊椎骨和两侧肋骨突起。四足均有5趾；趾间仅具蹼迹，足趾底面具吸盘（E对）。尾细而坚实（D对），微现骨节，与背部颜色相同，有6～7个银灰色环带，有的再生尾较原生尾短，且银灰色环带不明显。全身密被圆形或多角形微有光泽的细鳞。气腥，味微咸。